男，51岁，烧伤半小时。体温：36.2℃，心率112次/分，呼吸24次/分，血压85/60mmHg，查体神志清楚，痛苦面容，全身Ⅰ°烧伤达50%以上。该患者休克的主要原因为
A. 继发性感染
B. 过敏
C. 心输出量减少
D. 组织坏死
E. 低血容量及疼痛

正确答案：E。低血容量及疼痛

解析：中年男性患者，烧伤病史，休克体征，全身Ⅰ°烧伤达50%以上，属于烧伤面积较大的范围，当抢救不及时或不当，人体不足以代偿迅速发生的体液丧失时，则循环血量明显下降（E对），导致血流动力与流变学改变，进而发生休克。继发性感染（A错）一般有发热等全身毒血症状。过敏（B错）一般患者有过敏原接触史，且发作迅速，可伴有全身荨麻疹。心输出量减少（C错）一般见于充血性心衰、心梗等疾病。组织坏死（D错）一般会导致内源性感染引起休克，但不是烧伤休克的主要原因。